临床上固定义齿基牙牙槽骨退缩一般最多不超过根长的
A. 1/2
B. 1/3
C. 2/3
D. 1/4
E. 3/4

正确答案：B。1/3

解析：本题考查固定义齿的基牙选择要求。固定义齿基牙牙槽骨退缩最多不超过根长的1/3（B对）。牙根：牙根应长大、稳固，以多根牙的支持最好，不应存在病理性松动。若基牙牙根周围牙槽骨退缩，最多不超过根长的1/3，必要时，需增加基牙数目。